急性支气管炎风寒咳嗽证的治疗方剂
A. 杏苏散加减
B. 桑菊饮加减
C. 清金化痰汤加减
D. 沙参麦冬汤加减
E. 麻杏甘石汤加减

正确答案：A。杏苏散加减

解析：急性支气管炎风寒咳嗽证是由于风寒束肺，肺失宣降所致，治疗时应疏风散寒，宣肺止咳，首选为杏苏散（A对）。桑菊饮（B错）其功用为疏风清热，宣肺止咳，适用于急性支气管炎之风热咳嗽证。清金化痰汤（C错）其功用为清肺化痰止咳，适用于内伤咳嗽之痰热咳嗽。沙参麦冬汤（D错）其功用清养肺胃，生津润燥，适用于内伤咳嗽之阴虚咳嗽。麻杏甘石汤（E错）其功用为辛凉疏表，清肺平喘，适用于外感风邪，邪热壅肺证。